含有胆酸的中药是
A. 蟾酥
B. 牛黄
C. 水蛭
D. 地龙
E. 僵蚕

正确答案：B。牛黄

解析：本题考查的是含胆汁酸类成分的常用中药。含有胆酸的中药是牛黄（B对）。牛黄约含8%胆汁酸，主要成分为胆酸、去氧胆酸和石胆酸。此外，还含有7%SMC及胆红素，胆固醇，麦角固醇，多种氨基酸（如丙氨酸、甘氨酸、牛磺酸、精氨酸、天冬氨酸、蛋氨酸等）和无机盐等。《中国药典》以胆酸和胆红素为牛黄的质量控制成分，要求胆酸含量不少于4.0%，胆红素含量不得少于25.0%。蟾酥（A错）的化学成分复杂，主要成分有蟾蜍甾二烯类、强心甾烯蟾毒类、吲哚碱类、甾醇类以及肾上腺素、多糖、蛋白质、氨基酸和有机酸等，前两类成分具有强心作用。《中国药典》以蟾毒灵、华蟾酥毒基和脂蟾毒配基为指标成分进行含量测定，要求两者总量不得少于7.0%。水蛭（C错）主含蛋白质，含有17种氨基酸，水解氨基酸含量达49.4%，包括人体必需的8种氨基酸，其中谷氨酸含量高达8.3%；还含有Zn、Mn、Fe、Co、Cr、Se、Mo、Ni等14种微量元素。水蛭素是水蛭的主要有效药用成分。地龙（D错）中含有机酸丁二酸，为地龙止咳平喘的活性成分。僵蚕（E错）的化学成分，2022年考试指南未明确说明。